上颌纵曲线后段从第一磨牙的颊尖起逐渐向上弯曲称为
A. Spee曲线
B. 纵(牙合)曲线
C. 横(牙合)曲线
D. (牙合)平面
E. 补偿曲线

正确答案：E。补偿曲线

解析：本题考查牙列（牙合）面的形态特征。上颌纵曲线后段从第一磨牙的颊尖起逐渐向上弯曲称为补偿曲线（E对）。Spee曲线（A错）：从侧面观，连接下颌切牙的切缘、尖牙牙尖、前磨牙颊尖、磨牙颊尖，形成一条凹向上的弧形线，在前磨牙和第一磨牙区域最低，向后逐渐抬高，一直延伸至髁突颈的前缘，称为Spee曲线或者下颌的纵（牙合）曲线。上颌纵（牙合）曲线（B错）：在上颌，连接上颌切牙切缘、尖牙牙尖、前磨牙颊尖和磨牙颊尖，也形成一条凸向下的曲线，称为上颌纵（牙合）曲线。横(牙合)曲线（C错）：从正面观，连接上颌两侧同名磨牙的颊尖、舌尖，形成一条凸向下的弧形线，称为Wilson曲线或者上颌横（牙合）曲线。下颌相应的也有一条，只是上颌横（牙合）曲线是凸向下，而下颌横（牙合）曲线是凹向上，上下颌横（牙合）曲线彼此吻合。(牙合)平面（D错）：是一个参考平面，也是一个假想平面，指的是从上颌中切牙的近中邻接点到双侧第一磨牙的近中颊尖顶所构成的假想平面，该（牙合）平面与鼻翼耳屏线平行，基本上平分颌间距离。